甲肝的主要传播途径
A. 经粪﹣口途径传播
B. 注射输血传播
C. 垂直传播
D. 飞沫传播
E. 唾液传播

正确答案：A。经粪﹣口途径传播